肝火上炎的主要症状有
A. 面红目赤
B. 头痛眩晕
C. 口苦尿黄
D. 耳鸣耳聋
E. 吐血衄血

正确答案：A、B、C、D、E。面红目赤；头痛眩晕；口苦尿黄；耳鸣耳聋；吐血衄血

解析：本题考查的是肝火上炎证的临床表现及辨证要点。肝火上炎的主要症状有面红目赤（A对）、头痛眩晕（B对）、口苦尿黄（C对）、耳鸣耳聋（D对）与吐血衄血（E对）。肝火上炎证的临床表现及辨证要点：肝火上炎证临床表现，常见头痛眩晕，耳聋耳鸣，面红目赤，口苦，尿黄，甚则咯血、吐血、衄血，舌红苔黄，脉弦数。一般以肝脉循行所过的头、目、耳、胁部位见到实火炽盛症状作为辨证要点。